社区健康教育的基本目标是
A. 寻找致病原因
B. 降低发病率
C. 与社区居民建立良好关系
D. 提高社区居民的知信行水平
E. 确定社区主要健康问题

正确答案：D。提高社区居民的知信行水平